温脾汤的功效是
A. 温脾暖胃、攻逐冷积
B. 温肾暖脾、攻逐冷积
C. 温补脾肾、攻逐冷积
D. 温补脾阳、荡涤胃肠
E. 温补脾阳、攻下寒积

正确答案：E。温补脾阳、攻下寒积

解析：温脾汤方含大黄、芒硝可泻下冷积；附子、干姜可温中；当归养血润燥，一方面可润肠助泻下，一方面可防泻下伤正；甘草调和诸药，诸药合用，可攻下冷积，温补脾阳（E对）。